急性心肌梗死患者，疑有早期心源性休克，末梢循环改变，血压12/9.3kPa（90/70mmHg），尿比重1.016，中心静脉压13cmH₂O。治疗时应首选
A. 肾上腺素
B. 低分子右旋糖酐
C. 西地兰
D. 硝普钠
E. 心痛定

正确答案：B。低分子右旋糖酐

解析：急性心肌梗死患者如果合并心源性休克、末梢循环障碍，应首先静滴低分子右旋糖酐（B对）补充血容量。因为低分子右旋糖酐能提高血浆胶体渗透压，使已聚集的红细胞和血小板解聚，降低血液粘滞性，改善微循环和组织灌注。当中心静脉压＞18cmH₂O（正常值为5～10cmH₂O）时停止补液。肾上腺素（A错）可增强心肌收缩，增加心肌氧耗，因此禁用于急性心梗。急性心梗时西地兰（洋地黄）（C错）容易引发室性心律失常，应该慎用。硝普钠（D错）为强烈的血管扩张剂，只在血容量充足的情况下使用，否则会使血压降低、加重休克。心痛定（硝苯地平）（E错）为钙通道阻滞剂，可迅速降低血压，不宜用于心源性休克患者。